可摘局部义齿基牙观测时，二型观测线为
A. 近缺隙侧倒凹区小，远离缺隙侧倒凹区大
B. 近缺隙侧倒凹区小，远离缺隙侧倒凹区也小
C. 近缺隙侧倒凹区大，远离缺隙侧倒凹区小
D. 近缺隙侧倒凹区大，远离缺隙侧倒凹区也大
E. 近缺隙侧与远离缺隙侧均无倒凹区

正确答案：C。近缺隙侧倒凹区大，远离缺隙侧倒凹区小

解析：Ⅱ型观测线：为基牙向缺隙方向倾斜时所画出的观测线。此线在近缺隙侧距（牙合）面近，而远缺隙侧距（牙合）面远，说明近缺隙侧的倒凹大，远缺隙侧的倒凹小。掌握“局部义齿类型，肯氏分类及模型观测”知识点。